预防儿童青少年动脉粥样硬化膳食控制方案的主要内容是
A. 限制膳食中碳水化合物和蛋白质的摄入
B. 限制膳食中饱和脂肪酸和胆固醇的摄入
C. 限制膳食中不饱和脂肪酸和胆固醇的摄入
D. 限制蛋白质和脂肪的摄入
E. 限制所有供热营养素的摄入

正确答案：B。限制膳食中饱和脂肪酸和胆固醇的摄入